下列药物中主要作用于M期的药物有
A. 秋水仙碱
B. 丝裂霉素
C. 5-氟尿嘧啶
D. 阿霉素
E. 长春新碱

正确答案：A、E。秋水仙碱；长春新碱

解析：本题考查作用于M期的药物。下列药物中主要作用于M期的药物有秋水仙碱（A对）和长春新碱（E对）。M期特异性药物有秋水仙碱、长春新碱、长春碱、鬼臼毒素等。丝裂霉素（B错）、阿霉素（D错）为细胞周期非特异性药物。5-氟尿嘧啶（C错）为S期特异性药物。